急性心包填塞可引起
A. 心源性休克
B. 充血性心力衰竭
C. 两者均有
D. 两者均无
E. 无

正确答案：A。心源性休克

解析：急性心包填塞时，心包内过高的压力使心脏舒张期充盈受限，导致心排血量降低，严重心包填塞时可因心排血量显著降低，血压明显下降而导致心源性休克（A对）。